雷尼替丁属于
A. M受体阻断药
B. H+-K+-ATP酶抑制药
C. H₁受体阻断药
D. 胃泌素受体阻断药
E. H₂受体阻断药

正确答案：E。H₂受体阻断药